女，35岁。脸圆脸红向心性肥胖1年余。患者感明显的乏力与口干，腹部皮肤可见紫纹，皮肤薄，血压160/80mmHg，闭经1年。要明确左肺占位性病变与本病是否相关，需要的检查是
A. 大剂量地塞米松抑制试验
B. 测定血ACTH浓度
C. 过夜皮质醇节律加抑制试验
D. 生长抑素显像
E. 胸部MRI

正确答案：B。测定血ACTH浓度

解析：青年女性患者，向心性肥胖、腹部皮肤可见紫纹、皮肤薄、血压增高、闭经，为典型库欣综合征的表现，胸部CT检查发现左胸有占位性病变（胸部病变占异位ACTH综合征的60%左右，P701），应考虑异位ACTH综合征。异位ACTH综合征患者血ACTH升高显著，结合胸部CT左肺占位性病变，即可确诊异位ACTH综合征。因此血ACTH（B对）是可明确左肺占位性病变与本病是否相关需要的检查。大剂量地塞米松抑制试验（A错）主要用于库欣综合征病因的鉴别，无法明确肺部占位与本例临床表现的关系。库欣综合征患者均失去皮质醇的昼夜波动节律，小剂量地塞米松抑制试验均不被抑制，因此过夜皮质醇节律加抑制试验（C错）无鉴别诊断价值。生长抑素受体显像（D错）多用于胃肠胰肿瘤等的诊断。胸部MRI（E错）为影像学检查方法，不能确诊异位ACTH综合征。